休克早期微循环变化的特征是
A. 微动脉端收缩，微静脉端舒张
B. 微动脉端收缩，微静脉端不变
C. 微动脉端舒张，微静脉端舒张
D. 微动脉端舒张，微静脉端收缩
E. 微动脉端收缩程度大于微静脉端收缩

正确答案：E。微动脉端收缩程度大于微静脉端收缩

解析：休克初期即微循环缺血期，此期全身小血管，包括小动脉、微动脉、后微动脉、毛细血管前括约肌和微静脉、小静脉都发生收缩痉挛，口径明显变小，尤其是毛细血管前阻力血管收缩更明显，前阻力增加，也就是微动脉端收缩程度大于微静脉端收缩（E对ABCD错）。